运动神经元位于
A. 前角
B. 后角
C. 侧角
D. 脊髓圆锥
E. 无

正确答案：A。前角

解析：每侧的灰质，前部扩大为前角，运动神经元位于前角（A对），后部狭细为后角（B错），在胸髓和上腰髓 (T1～L3), 中间带外侧部向外伸出侧角，侧角（C错）在脊髓第一胸节到第三腰节的横切面上可见到的灰质部分，脊髓圆锥（D错）尖端约平对第 1 腰椎下缘（新生儿可达第 3 腰椎下缘）。